以下细菌中营养要求高、繁殖最慢的是
A. 大肠埃希菌
B. 丙型链球菌
C. 脑膜炎奈瑟菌
D. 结核分枝杆菌
E. 肺炎链球菌

正确答案：D。结核分枝杆菌

解析：结核菌为专性需氧菌，营养要求高，生长缓慢，常用罗氏培养基（内含蛋黄、甘油、马铃薯和孔雀绿等）进行培养，需3～4周后才形成颗粒状或菜花形的乳酪色的粗糙型菌落。掌握“结核、非结核分枝杆菌”知识点。